患者，女，27岁，已婚。停经8周，2天来阵发性下腹痛伴阴道出血，现出血多于平时月经量，色鲜红。妇检宫颈口松容1指，宫体如孕50天大小，质软。应首先考虑的是
A. 月经过多
B. 输卵管妊娠流产
C. 先兆流产
D. 难免流产
E. 不全流产

正确答案：E。不全流产

解析：患者已婚，孕8周，2天来有阵发性下腹痛伴阴道出血，出血量多，色红，且宫颈口开一指，宫体较孕周小，据此判断患者为小产即不全流产（E对）。患者孕8周，妊娠期，无月经（A错）。输卵管妊娠流产主要症状：阴道出血点滴状或少量褐色，少腹隐痛、突发剧痛，无或有蜕膜组织，宫颈闭或松，宫体大小较孕周小（B错）。先兆流产主要症状：阴道出血量少，淡红，暗红或鲜红或黯红，下腹不痛或轻痛。妇科检查宫颈未扩张，宫体于孕周相符（C错）。难免流产主要症状：阴道出血增多，色鲜红，下腹痛加剧，妇科检查宫颈已扩张，宫体大小于孕周相符（D错）。